《中国药典》一部规定，大黄检查项要检查
A. 结合性葸醌类衍生物
B. 游离蒽醌类衍生物
C. 土大黄苷
D. 双蒽酮苷
E. 鞣质

正确答案：C。土大黄苷